亚急性感染性心内膜炎最常见致病菌为
A. 立克次体
B. 金黄色葡萄球菌
C. 肺炎球菌
D. 淋球菌
E. 草绿色链球菌

正确答案：E。草绿色链球菌

解析：链球菌和葡萄球菌是引起IE（感染性心内膜炎）的主要病原微生物。其中亚急性感染性心内膜炎（P308）的常见致病菌是草绿色链球菌（E对）；金黄色葡萄球菌（B错）、肺炎球菌（C错）和淋球菌（D错）多引起急性感染性心内膜炎；立克次体（A错）为自体瓣膜心内膜炎的少见致病菌。